患者，女，28岁。主诉腭咽弓左侧疼痛15天，进食时疼痛加剧。检查：左侧软腭部见1.5cm×1.5cm大小溃疡，上覆白色假膜，周边红肿隆起，触诊基底稍硬，触痛明显，有类似发作史。最可能的诊断是
A. 硬下疳
B. 复发性坏死性黏膜腺周围炎
C. 疱疹样口疮
D. 天疱疮
E. 轻型阿弗他溃疡

正确答案：B。复发性坏死性黏膜腺周围炎

解析：本题考查复发性坏死性黏膜腺周围炎的诊断。患者腭咽弓左侧疼痛，左侧软腭部1.5cm×1.5cm大小溃疡，白色假膜，红肿隆起，基底稍硬，触痛，有类似发作史。综合考虑诊断为复发性坏死性黏膜腺周围炎（B对）。重型复发性阿弗他溃疡（MaRAU）亦称复发性坏死性黏膜腺周围炎或腺周口疮，溃疡大而深，外观似弹坑，愈合留瘢痕。硬下疳（A错）主要是一期梅毒的主要表现，发生在患者的外生殖器上，初期症状为患者会有小片的红斑，并且会迅速发展为无痛性炎症丘疹。疱疹样口疮（C错）主要表现为起病时发热达38℃～40℃，1～2天后，齿龈、唇内、舌、颊粘膜等各部位口腔粘膜出现单个或成簇的小疱疹，直径2～3mm，周围有红晕，迅速破溃后形成溃疡，有黄白色纤维素性分泌物覆盖。天疱疮（D错）是一类重症的皮肤病。特征为薄壁、易于破裂的大疱。轻型阿弗他溃疡（E错）主要表现为初起局灶性黏膜充血水肿，呈粟粒状红点继而形成浅表溃疡，溃疡直径小于10mm。以上均不符合本病例的临床表现，应诊断为复发性坏死性黏膜腺周围炎。